下列各项不属于艾滋病传播途径的是
A. 性接触
B. 输血
C. 器官移植
D. 母婴传播
E. 蚊虫叮咬

正确答案：E。蚊虫叮咬

解析：艾滋病传播途径1.性接触传播 最主要的传播途径，包括同性、异性和双性性接触。病毒可通过性接触摩擦引起的细微破损进人机体（A对）。2.血液及血制品传播 血液中HIV含量最高。输入被HIV污染的血液或血制品（B对）。共用针具静脉注射毒品、介入性医疗操作（C对）、文身等可被感染。3.母婴传播 HIV可通过胎盘、产程中及产后血性分泌物、哺乳等传给胎儿。有11%～60%HIV阳性孕妇有母婴传播风险（D对）。握手、拥抱、礼节性亲吻、同吃同饮等日常接触不会传播HIV（E错，为本题正确答案）。